牙源性钙化上皮瘤又称
A. 圆柱瘤
B. 淋巴乳头状囊腺瘤
C. Pindborg瘤
D. Warthin瘤
E. 多形性腺瘤

正确答案：C。Pindborg瘤

解析：牙源性钙化上皮瘤又称Pindborg瘤。掌握“牙源性钙化上皮、囊性瘤”知识点。